孕妇应慎用的药物是
A. 金银花
B. 连翘
C. 牛黄
D. 鱼腥草
E. 蒲公英

正确答案：C。牛黄

解析：因某些药物具有损害胎元而致堕胎的副作用，故作为妊娠禁忌药物。根据其对于胎元损害程度的不同，可分为慎用药与禁用药两大类。慎用的药物包括痛经祛瘀、行气破滞及辛热滑利之品。金银花为清热解毒药，脾胃虚寒及气虚疮疡脓清者忌用（A错）。连翘为清热解毒药，脾胃虚寒及气虚脓清者不宜用（B错）。牛黄为息风止痉药，药性苦寒，气味芳香，泻火之力较强，易致孕妇流产，且牛黄尤其是人工牛黄易导致过敏（C对）。鱼腥草为清热解毒药，虚寒证及阴证疮疡忌用（D错）。蒲公英为清热解毒药，用量过大可致缓泻（E错）。